给患者以酸性物质根据腺体本身变化和分泌情况，判断腺体的分泌功能和导管的通畅程度。属于涎腺分泌功能检查的
A. 分析检查
B. 定性检查
C. 定量检查
D. 荧光免疫检查
E. 定期检查

正确答案：B。定性检查

解析：本题考查唾液腺分泌功能检查。给患者以酸性物质根据腺体本身变化和分泌情况，判断腺体的分泌功能和导管的通畅程度。属于涎腺分泌功能检查的定性检查（B对）。分泌功能的检测主要包括定性检查和定量检查。定量检查（C错）：是根据相同刺激条件下，腮腺和下颌下腺唾液分泌量多少来协助某些唾液腺疾病的诊断。分析检查（A错）指为评价样品分析的可靠性而进行检查分析。荧光免疫检查（D错）指用免疫荧光技术显示和检查细胞或组织内抗原或半抗原物质的方法。定期检查（E错）指每隔一段时间就要进行检查。